某男，50岁。数月来，潮热盗汗，咽干咳血，眩晕耳鸣，腰膝软。证属肺肾阴亏。治当滋肾养肺，宜选用的成药是
A. 玉泉丸
B. 左归丸
C. 薯蓣丸
D. 大补阴丸
E. 麦味地黄丸

正确答案：E。麦味地黄丸

解析：本题考查的是麦味地黄丸的功能。数月来，潮热盗汗，咽干咳血，眩晕耳鸣，腰膝软。证属肺肾阴亏。治当滋肾养肺，宜选用的成药是麦味地黄丸（E对）。麦味地黄丸：【功能】滋肾养肺。玉泉丸（A错）：【功能】清热养阴，生津止渴。左归丸（B错）：【功能】滋肾补阴。薯蓣丸（C错）：【功能】调理脾胃，益气和营。大补阴丸（D错）：【功能】滋阴降火。